不属于大气污染的健康危害的是
A. 呼吸道炎症
B. 微量元素缺乏
C. 变态反应性疾病
D. 机体免疫力下降
E. 心血管疾病死亡率升高

正确答案：B。微量元素缺乏

解析：本题考查大气污染对健康的危害。大气污染对健康的危害有直接危害和间接危害。呼吸道炎症（A对），变态反应性疾病（C对），机体免疫力下降（D对），心血管疾病死亡率升高（E对）均属于大气污染对健康的危害。微量元素缺乏（B错，为本题正确答案）不属于大气污染的健康危害。